感染性中毒休克采用
A. 糖皮质激素替代治疗法
B. 早期、大剂量、短期应用糖皮质激素
C. 抗菌药物与糖皮质激素合用
D. 抗结核病药与糖皮质激素合用
E. 糖皮质激素与肾上腺素合用

正确答案：B。早期、大剂量、短期应用糖皮质激素

解析：本题考查感染性中度休克的治疗。感染性中毒休克采用早期、大剂量、短期应用糖皮质激素（B对）。大剂量冲击疗法用于严重中毒性感染及各种休克，宜短期内用大剂量。糖皮质激素替代治疗法（A错）用于垂体前叶功能减退和慢性肾上腺皮质功能不全者。抗菌药物与糖皮质激素合用（C错）用于急性细菌感染的治疗。抗结核病药与糖皮质激素合用（D错）一般用于结核病菌感染的患者。糖皮质激素与肾上腺素合用（E错）用于过敏性休克。